关于妄想以下哪项不正确
A. 妄想都是与事实不相符的信念
B. 妄想是一种病理性的歪曲信念
C. 妄想是可以通过摆事实，讲道理说服的信念
D. 妄想是一种坚信不疑的信念
E. 妄想与患者的文化水平，社会背景相称

正确答案：C。妄想是可以通过摆事实，讲道理说服的信念

解析：妄想内容与事实不符（A对），但患者仍坚信不移（D对）（C错，为本题正确答案）。妄想是在病态推理和判断基础上形成的一种病理性的歪曲的信念（B对）。妄想内容与患者的文化背景和经历有关（E对）。在这里A选项表述得过于绝对，应强调的是妄想的概念，是在病态推断和判断基础上形成的一种病理性的歪曲的信念，在这种情况下，重要的是得出信念的过程是病态的，而结论是次要的。但C项的错误更加明显，故本题选择C为正确答案。